当研究人群数量大且流动性很强，描述发病强度的指标是
A. 发病密度
B. 累积患病率
C. 累积发病率
D. 累积死亡率
E. 累积感染率

正确答案：A。发病密度

解析：本题考查发病密度的概念。发病密度（A对BCDE错）是指用人时为单位计算出来的带有瞬时频率性质的率，反映的是速率。当研究对象进出队列的时间先后不一，整个队列呈现动态状态时，需用发病密度进行计算。